根据《中华人民共和国药品管理法实施条例》规定，除法律、行政法规另有规定外，非药品不得在其包装、标签、说明书及有关宣传资料上进行宣传的内容是
A. 预防人体疾病
B. 治疗人体疾病
C. 诊断人体疾病
D. 人体保健康复
E. 增强人体营养

正确答案：A、B、C。预防人体疾病；治疗人体疾病；诊断人体疾病

解析：本题考查非药品的宣传。除法律、行政法规另有规定外，非药品不得在其包装、标签、说明书及有关宣传资料上进行宣传的内容是预防人体疾病（A对）、治疗人体疾病（B对）、诊断人体疾病（C对）。